口干症状见于
A. 白色念珠菌病
B. 球菌性口炎
C. 白斑
D. 扁平苔藓
E. 复发性口腔溃疡

正确答案：D。扁平苔藓

解析：本题考查白斑的临床表现。口干症状见于扁平苔藓（D对）。扁平苔藓（OLP）（D对）患者自觉黏膜粗糙、木涩感、烧灼感、口干，偶有虫爬、痒感。遇辛辣、热、酸、咸味食物刺激时，病损局部敏感、灼痛。